基本生命中枢位于
A. 脊髓
B. 延髓
C. 脑桥
D. 中脑
E. 下丘脑

正确答案：B。延髓

解析：基本生命中枢位于延髓（B对），许多基本生命现象（如循环、呼吸等）的反射调节在延髓水平已初步完成，因此延髓有“生命中枢”之称”。脊髓（A错）是内脏反射活动的初级中枢，基本的血管张力反射、发汗反射、排尿、反射、排便反射、阴茎勃起反射等可在脊髓水平完成。脑桥（C错）参加呼吸节律的控制以及肌紧张和肌肉运动的调节。中脑（D错）是瞳孔对光反射的中枢部位。下丘脑（E错）是参与体温调节、水平衡调节、本能行为和情绪调节、内分泌活动调节以及生物节律控制等的中枢。